目前认为人类主要致龋菌是
A. 乳酸杆菌
B. 唾液链球菌
C. 血链球菌
D. 变形链球菌
E. 轻链球菌

正确答案：D。变形链球菌

解析：本题考查人类主要的致龋菌。变形链球菌（D对）为口内主要致龋链球菌。乳酸杆菌（A错）具有致龋性，但次于变异链球菌，且仅能导致窝沟龋。唾液链球菌（B错）为口腔正常菌群，对人类无致龋性。血链球菌（C错）的数量与龋病损害的出现呈反比。目前尚无报告证实轻链球菌（E错）与龋病的正相关关系。